《中国药典》中测定阿司匹林含量的方法是
A. 酸碱滴定法
B. 亚硝酸钠滴定法
C. 碘量法
D. 高效液相色谱法
E. 气相色谱法

正确答案：A。酸碱滴定法

解析：本题考查含量测定。《中国药典》中测定阿司匹林含量的方法是酸碱滴定法（A对）。《中国药典》中规定，阿司匹林的含量测定方法为：取本品约0.4g，精密称定，加中性乙醇（对酚酞指示液显中性）20ml溶解后，加酚酞指示液3滴，用氢氧化钠滴定液（0.1mol/L）滴定。每1ml的氢氧化钠滴定液（0.1mol/L）相当于18.02mg的C₉H₈0₄，因此阿司匹林的含量分析应使用酸碱滴定法，即中和滴定法。亚硝酸钠滴定法（B错）是用亚硝酸钠滴定液在盐酸溶液中与芳伯氨基定量发生重氮化反应，生成重氮盐以测定含芳伯氨基或含潜在芳伯氨基药物的含量。碘量法（C错）是以碘作为氧化剂，或以碘化钾作为还原剂进行氧化还原滴定的方法，用于测定具有还原性的药物。高效液相色谱法（D错）系采用高压输液泵将规定的流动相泵入装有填充剂的色谱柱，对已注入色谱柱的供试品进行分离测定的方法。气相色谱法（E错）用气体作为流动相载气，常用于性质不稳定，沸点低易气化物质的分离测定。